影响药物排泄，延长药物体内滞留时间的因素是
A. 首过效应
B. 肝肠循环
C. 血脑屏障
D. 胎盘屏障
E. 血眼屏障

正确答案：B。肝肠循环

解析：本题考查肝肠循环。肠肝循环（B对）是指随胆汁排入十二指肠的药物或其代谢物，在肠道中重新被吸收，经门静脉返回肝脏，重新进入血液循环的现象；首过效应（A错）是指口服药物在尚未吸收进入血循环之前被代谢，使进入血循环的原形药量减少的现象；血脑屏障（C错）是血液与脑组织之间的屏障；胎盘屏障（D错）是由胎盘绒毛与子宫血窦构成的，将母体与胎儿血液隔开的屏障；血眼屏障（E错）是血液与眼部的房水、晶状体和玻璃体等组织之间存在的屏障。